在检验某因素与某病的因果联系时，下列哪种观察方法最有效
A. 现患调查
B. 生态学研究
C. 前瞻性队列研究
D. 抽样调查

正确答案：C。前瞻性队列研究

解析：本题考查验证病因假设的方法。队列研究由于病因发生在前，疾病发生在后，因果现象发生的时间顺序是合理的，加之偏倚较少，又可直接计算各项测械疾病危险强度的指标，故其检验病因假说的能力较强，一般可证实病因联系。队列研究主要包括前瞻性队列研究（C对ABD错）、历史性队列研究、双向性队列研究。